据以往经验，新生儿染色体异常率一般为1%，某医院观察了当地400名新生儿，只有1例染色体异常，欲检验该地新生儿染色体异常率是否低于一般，应进行
A. 两样本率比较的双侧检验
B. 两样本率比较的单侧检验
C. 样本率与总体率比较的双侧检验
D. 样本率与总体率比较的单侧检验
E. 秩和检验

正确答案：D。样本率与总体率比较的单侧检验